可用于口服缓（控）释制剂的亲水凝胶骨架材料是
A. 乙基纤维素
B. 硬脂醇
C. 巴西棕榈蜡
D. 海藻酸钠
E. 聚乙烯

正确答案：D。海藻酸钠

解析：本题考查骨架型缓释材料。亲水性凝胶骨架材料可分为4类。①天然胶，如海藻酸盐（D对）、琼脂等；②纤维素衍生物，如甲基纤维素（MC）、羧甲基纤维素钠（CMC-Na）、羟丙甲纤维素（HPMC）、羟乙基纤维素（HEC）等；③非纤维素多糖类，如甲壳素、壳聚糖、卡波姆等；④高分子聚合物，如聚维酮（PVP）、聚乙烯醇（PVA）等。乙基纤维素（A错）和聚乙烯（E错）为不溶性骨架材料。硬脂醇（B错）和巴西棕榈蜡（C错）为溶蚀性骨架材料。